男性，60岁，因胃溃疡合并多次大出血，行胃大部切除术。该病人术后可能出现的营养性并发症不包括
A. 体重减轻
B. 溶血性贫血
C. 腹泻
D. 脂肪泻
E. 骨病

正确答案：B。溶血性贫血

解析：胃大部切除后，壁细胞减少，盐酸和内因子分泌减少。盐酸分泌减少，食物过快进入空肠，绕过铁的主要吸收部位（十二指肠），使铁吸收障碍，可导致缺铁性贫血；内因子分泌减少，使维生素B₁₂吸收障碍，易导致巨幼细胞性贫血（B错，为本题正确答案）。胃大部切除术后，胃容量减少，容易出现饱胀感，使能量摄入不足；胃大部切除术后，食物过快进入空肠，不能与胰液、胆汁很好的混合，使胰酶、胆汁不能充分发挥其功能，影响脂肪、氨基酸等营养物质的吸收，造成脂肪泻（D对）、腹泻（C对）。综上，胃大部切除术后由于解剖、生理的改变，使食物摄入、消化和吸收功能障碍，可引起体重下降、营养不良等并发症（A对）。胃大部切除术后，约有1/3病人可有病人出现钙、磷代谢紊乱，出现骨质疏松、骨软化等骨病（E对）。